男，60岁，突发性心前区疼痛2小时既往有高脂血症和吸烟史，无高血压和出血性疾病史，查体：BP150/90mmHg，双肺呼吸音清，心率89次每分钟，律齐，心电图示V1-V6导联ST段弓背向上抬高0.3-0.5mV。该患者最可能累及的部位为
A. 前降支
B. 右冠状动脉
C. 回旋支
D. 左主干
E. 左冠状动脉

正确答案：A。前降支

解析：患者60岁男性，突发性心前区疼痛2小时（心肌梗死临床表现），既往有高脂血症和吸烟史，心电图示V1-V6导联ST段弓背向上抬高0.3-0.5mV（急性ST段抬高型心肌梗死特征性改变），根据P238表3-4-4可知该患者最可能的诊断是急性广泛前壁心肌梗死，主要是由于前降支（A对）的近端出现了堵塞，引起左心室前壁、心尖部、下侧壁、前间隔和二尖瓣前乳头肌梗死。